降低肾素活性最明显的药物是
A. 氢氯噻嗪
B. 可乐定
C. 肼苯哒嗪
D. 普萘洛尔
E. 利血平

正确答案：D。普萘洛尔

解析：普萘洛尔：β受体阻断作用较强，无内在拟交感活性。通过阻断肾小球旁器细胞的β1而抑制肾素的释放，从而为显现降压作用称为可能。掌握“抗高血压药”知识点。